治疗痰浊痹阻之胸痹，宜首选
A. 半夏
B. 天南星
C. 浙贝母
D. 川贝母
E. 瓜蒌

正确答案：E。瓜蒌

解析：瓜蒌能利气开郁，导痰浊下行而奏宽胸散结之功，治疗痰气交阻，胸阳不振之胸痹疼痛（E对）。半夏（A错）味辛性温，长于燥湿化痰止咳，为燥湿化痰、温化寒痰之要药，尤善治脏腑湿痰。天南星（B错）味苦辛性温，应用于顽痰咳嗽，风痰眩晕，中风痰壅，惊风，半身不遂等。浙贝母（C错）长于清热化痰，降泻肺气，多用于治风热咳嗽及痰热郁肺之咳嗽。川贝母（D错）性寒味微苦，能清肺化痰，又味甘质润能润肺止咳，尤宜于内伤咳嗽，燥痰、热痰之证。